患者，男，65岁。胃痛隐隐，久痛不减，心下痞胀，口燥咽干，便秘，舌红苔少，脉细数。其证型是
A. 肝胃不和
B. 痰食交阻
C. 痰瘀内结
D. 胃阴亏虚
E. 气血两亏

正确答案：D。胃阴亏虚

解析：患者以胃痛为主诉，故诊断为胃痛；胃痛日久，郁热伤阴，胃失濡养，故见胃痛隐隐，久痛不减，心下痞胀。阴虚津少，无以上承，则口燥咽干，阴虚液耗，无以下溉，则肠道失润而见便秘。舌红苔少，脉象细数为阴虚内热之证。故诊断为胃阴亏虚证（D对）。肝胃不和之胃痛可见胃脘胀痛，痛连两胁，嗳气、矢气则痛舒（A错）。